属于第一级预防措施的是
A. 健康检查
B. 产前检查
C. 遗传咨询
D. 早期诊断
E. 病后恢复

正确答案：C。遗传咨询